世界上最早的具有药典性质的本草是
A. 《神农本草经》
B. 《新修本草》
C. 《证类本草》
D. 《本草纲目》
E. 《植物名实图考》

正确答案：B。《新修本草》